能用拇指示指对指取小物品的年龄是
A. 8个月
B. 9个月
C. 15个月
D. 18个月
E. 24个月

正确答案：B。9个月

解析：本题考查儿童精细动作发育规律的相关内容。9月龄（B对ACDE错）时拇、示指拾物，喜撕纸；16月龄用笔乱涂，学用匙。